连某，因患严重的躁狂抑郁障碍正在精神病专科医院住院治疗。因病情恶化，患者出现伤人毁物等行为，医院在没有其他可替代措施的情况下，对其实施了约束身体的措施，但实施后没有及时通知连某的监护人。连某的父亲作为监护人探视时，看到儿子被捆绑在病床上非常气愤。该案例中所形成的医患关系模式是
A. 主动-被动型
B. 指导-合作型
C. 契约许可型
D. 指导参与型
E. 共同参与型

正确答案：A。主动-被动型

解析：1956年，美国学者萨斯与荷伦德发表了《医患关系的基本模式》一文，指出病人症状的严重程度是影响医师与病人各自主动性大小的重要因素，依此将医患关系归纳为三种类型：主动-被动型、指导-合作型、共同参与型（CD错）。主动-被动型指医师主动命令，病人被动服从，适合难以表述自己主观意见的病人。医生对躁狂抑郁障碍患者连某实施了约束身体的措施，形成的医患关系模式是属于主动-被动型（A对）。指导-合作型（B错）是指在医疗活动中，医患双方具有一定的主动性，但仍以医务人员为主，适合于急性感染期病人。共同参与型（E错）指医患双方共同制定并实施诊断方案，适合长期慢性疾病病人和心理疾病病人。